与全口义齿稳定无关的是
A. 良好的咬合关系
B. 适当的基托伸展
C. 理想的磨光面形态
D. 合理的人工牙排列
E. 具有平衡（牙合）

正确答案：B。适当的基托伸展

解析：影响稳定的因素有如下几点：①颌骨的解剖形态；②上下颌弓的位置关系；③承托区黏膜的厚度；④人工牙的排列位置与咬合关系；⑤颌位关系；⑥义齿基托磨光面的形态。而适当的基托伸展有利于义齿的固位，与稳定无关。掌握“全口义齿固位及稳定”知识点。